健康促进中起主导作用的是
A. 公众
B. 牙防指导组
C. 主要行政领导
D. 口腔医务工作者
E. 口腔医学院校教师

正确答案：D。口腔医务工作者

解析：本题考查口腔健康促进。健康促进中起主导作用的是口腔医务工作者（D对）。口腔医务工作者主要在“提供有效的预防方法和口腔健康行为指导”方面起着主导的作用。口腔健康促进是从组织上、经济上创造条件，并保证公众（A错）得到适宜的口腔疾病预防措施。实施有效的口腔预防措施必须以口腔健康教育为基础，口腔健康教育是口腔健康促进中必不可少的一部分，可以增加人们的健康知识，理解并实践相关的口腔预防措施。牙防指导组（B错）和口腔医学院校教师（E错）是口腔健康教育的重要实施者。主要行政领导（C错）在口腔健康促进中起着决定性的作用。